患者便血紫黯，甚则黑色，腹部隐痛，喜热饮，面色不华，神倦懒言，便溏，舌质淡，脉细。治疗应首选
A. 当归补血汤
B. 归脾汤
C. 黄土汤
D. 无比山药丸
E. 黄芪建中汤

正确答案：C。黄土汤

解析：脾胃虚寒，中气不足，统血无力，血溢肠内，随大便而下，故便血紫黯，甚则黑色；中虚有寒，寒凝气滞，健运失司，故腹部隐痛，喜热饮，便溏；脾胃虚寒，气血不足，故面色不华，神倦懒言，舌质淡，脉细，故诊断为脾胃虚寒证，治以健脾温中，养血止血，代表方为黄土汤（C对）。当归补血汤，其功用为补气生血，适用于血虚阳浮发热证（A错）。归脾汤，其功用为益气补血，健脾养心，可用于鼻衄之气血亏虚证(B错)。无比山药丸，其功用健脾益肾，可用于劳淋证（D错）。黄芪建中汤，其功用为温中健脾，和胃止痛，可用于胃痛之脾胃虚寒证（E错）。